一项有关血脂是否引起冠心病的队列研究，在随访过程中，下述研究对象被认为到了观察的终点
A. 血脂升高的人
B. 猝死于脑卒中的人
C. 诊断为高血压的人
D. 诊断为冠心病的人
E. 因交通意外死亡的人

正确答案：D。诊断为冠心病的人

解析：本题考查观察终点。观察终点是指研究对象出现了预期的结果，达到了这个观察终点，就不再对该研究对象继续随访，对该对象的观察结束（D对ABCE错）。